吗啡和哌替啶的共同作用不包括
A. 体位性低血压
B. 止泻
C. 抑制呼吸
D. 镇痛
E. 成瘾性

正确答案：B。止泻

解析：吗啡的药理作用主要包括镇痛作用（D）；镇静、致欣快作用；抑制呼吸（C）；镇咳；缩瞳；吗啡提高回盲瓣及肛门括约肌张力，加之对中枢的抑制作用，使便意和排便反射减弱，因而引起便秘（B）；吗啡对心率及节律均无明显影响，能扩张血管，降低外周阻力，当患者由仰卧位转为直立时可发生直立性低血压（A），部分与其促进组胺释放有关；依赖性表现为停药后出现戒断症状，甚至意识丧失，患者出现病态人格，有明显强迫性觅药行为，即出现成瘾性（E）。哌替啶镇痛作用弱于吗啡（D），镇静、呼吸抑制（C）、致欣快和扩血管作用（A）与吗啡相当。久用产生耐受性和依赖性（E），禁忌症和吗啡相同。故哌替啶无止泻作用（B对）。